下列哪项不是疥疮的临床特点
A. 好发于皮肤皱褶部位
B. 皮损初起为针头大小的丘瘆或水疱
C. 幼儿可见于面部及头部
D. 全身遍布抓痕、结痂、黑色斑点和脓疱
E. 轻度瘙痒

正确答案：E。轻度瘙痒

解析：疥疮患者常有奇痒（E错，为本题正确答案），遇热或夜间尤甚，常影响睡眠。皮损好发于皮肤薄嫩和皱褶处（A对），如手指侧、指缝、腕肘关节屈侧、腋窝前缘、女性乳房下、少腹、外阴、腹股沟、大腿内侧等处。头面部和头皮、掌跖一般不易累及，但婴幼儿例外（C对）。皮损初起为针头大小的丘疹或水疱（B对），如不及时治疗，迁延日久则全身遍布抓痕、结痂、黑色斑点，甚至脓疱（D对）。